第一次卫生革命的主要防治对象是
A. 心血管疾病
B. 意外伤害
C. 癌症
D. 传染病和寄生虫病等
E. 突发公共卫生事件

正确答案：D。传染病和寄生虫病等